百合固金汤所治阴虚证的主要脏腑是
A. 肺肾
B. 肝胃
C. 心肝
D. 脾胃
E. 肺胃

正确答案：A。肺肾

解析：百合固金汤证乃由肺肾阴虚，虚火上炎所致（A对）。肺失濡润，火伤血络，故咳嗽气喘、痰中带血;阴精不足，头目失养，故头晕目眩；阴虚则生内热，故午后潮热、骨蒸盗汗；喉为肺系，肾脉挟咽，肺肾阴亏，津液不能上潮咽喉，加之虚火上攻，故咽喉燥痛，舌红少苔、脉细数，为阴虚内热之象。治宜滋养肺肾之阴，止咳祛痰。